发挥自己的潜能，实现自已的理想与抱负的需要是
A. 生理需要
B. 安全需要
C. 爱与被爱的需要
D. 尊重的需要
E. 自我实现的需要

正确答案：E。自我实现的需要

解析：自我实现需要：理想、抱负。掌握“需要与动机”知识点。